推荐气雾吸入给药，用药后支气管扩张、立即平喘的是
A. 沙丁胺醇
B. 克仑特罗
C. 特布他林
D. 福莫特罗
E. 沙美特罗

正确答案：A。沙丁胺醇